下列疾病导致左心室前负荷增加的是
A. 肺动脉高压
B. 二尖瓣狭窄
C. 高血压
D. 肺动脉瓣狭窄
E. 主动脉瓣关闭不全

正确答案：E。主动脉瓣关闭不全

解析：主动脉瓣关闭不全（E对）时，舒张期主动脉内血流大量反流入左心室，使左心室舒张末容量增加，导致左心室前负荷增加。肺动脉高压（A错）、肺动脉瓣狭窄（D错）导致右心室后负荷增加。二尖瓣狭窄（B错）直接导致左心室前负荷减小，随病情发展可间接导致右心后负荷增加。高血压（C错）导致左心室后负荷增加。